氯化消毒剂灭菌的主要作用是
A. 吞噬作用
B. 溶菌作用
C. 破坏细菌的生活环境
D. 干扰细菌的糖代谢
E. 抑制细菌对氧的利用

正确答案：D。干扰细菌的糖代谢

解析：本题考查氯化消毒剂灭菌的主要作用。氯化消毒剂灭菌的主要作用是干扰细菌的糖代谢（D对ABCE错）。氯的杀菌作用机制是由于次氯酸体积小，电荷中性，易于穿过细胞壁；同时，它又是一种强氧化剂，能损害细胞膜，使蛋白质、RNA和DNA等物质释出，并影响多种酶系统（主要是磷酸葡萄糖脱氢酶的巯基被氧化破坏），从而使细菌死亡。